关于下颌升支边缘性骨髓炎影像学表现以下哪项是错误的
A. 病灶区大量死骨形成
B. 升支部位弥漫性密度增高
C. 病灶区可见局限性骨质破坏灶
D. 骨质增生为主
E. CT横断面图像可显示骨膜下成骨

正确答案：A。病灶区大量死骨形成

解析：边缘性颌骨骨髓炎：①感染来源以下颌智齿冠周炎为主；②感染途径是先形成骨膜下脓肿或蜂窝织炎，主要破坏密质骨，很少破坏松质骨；③临床表现多为局限的，弥漫型较少；④骨髓炎的病源牙多无明显炎症和松动；⑤病变多发生在下颌角及升支，很少波及颌骨体；⑥慢性期X线见骨质疏松脱钙或骨质增生硬化，或有小死骨块，与周围骨质无明显分开。掌握“颌骨骨髓炎”知识点。